女，60岁。食欲不振，腰背部胀痛半年，皮肤逐渐黄染，大便灰白色3个月。发病以来体重下降10kg。查体：T36.5℃，P80次/分，R18次/分，BP120/80mmHg，皮肤巩膜黄染，心肺查体未见明显异常，腹部无压痛、肌紧张，右肋下可触及肿大胆囊，无触痛。实验室检查：血胆红素78μmol/L，直接胆红素65μmol/L。该病人手术前，重要的辅助检查是
A. 胃镜
B. 上消化道造影
C. 腹部立位X线平片
D. 腹部B超
E. 腹部CT

正确答案：E。腹部CT

解析：老年女性患者，腰背部胀痛，食欲不振，体重下降，皮肤逐渐黄染，大便灰白色，血胆红素和直接胆红素升高。右肋下可触及肿大胆囊，无触痛（Courvoisier征）。Courvoisier征是指在胰头癌压迫胆总管导致阻塞时，发生明显黄疸，且逐渐加深，胆囊显著肿大，但无压痛，称为Courvoisier征，又称胆总管渐进阻塞征。多见于胰头癌，胆管下端癌。因此首先考虑的诊断是胰头癌（E对）。该病人手术前，重要的辅助检查是腹部CT（E对）。胰腺动态薄层增强扫描及三维重建是首选的影像学检查，可为胰腺肿瘤的定性、定位诊断提供非常重要的影像学依据，尤其在术前对胰腺肿瘤可切除性评估具有重要意义。B型超声（D错）：主要用于常规检查，对胰胆管扩张比较敏感，但对胰腺常显示不清。